下列有关蛋白质的叙述哪一项是不正确的
A. 蛋白质分子都具有一级结构
B. 蛋白质的二级结构是指多肽链的局部构象
C. 蛋白质的三级结构是整条肽链的空间结构
D. 蛋白质分子都具有四级结构
E. 蛋白质四级结构中亚基的种类和数量均不固定

正确答案：D。蛋白质分子都具有四级结构

解析：蛋白质的结构可以分为四级，氨基酸残基的排列顺序决定蛋白质的一级结构，多肽链中的局部特殊构象是蛋白质的二级结构，多肽链在二级结构基础上进一步折叠形成蛋白质的三级结构，某些蛋白质具有四级结构形式（具有四级结构的某些蛋白质是由多亚基组成），所以并不是所有的蛋白质分子都具有四级结构。掌握“蛋白质结构与功能关系”知识点。